内分泌系统
A. 包括内分泌腺和内分泌组织构成
B. 是神经系以外的一个重要的调节系统
C. 对机体的新陈代谢、生长发育、生殖机能等都有重要的调节作用
D. 内分泌腺称无管腺，其分泌物称激素
E. 以上都正确

正确答案：E。以上都正确

解析：内分泌系统是神经系以外的一个重要的调节系统（B对），与神经系统相辅相成，共同维持机体内环境的平衡与稳定，对机体的新陈代谢、生长发育、 生殖机能等都有重要的调节作用（C对）。内分泌系统由内分泌腺和内分泌组织组成（A对）。内分泌腺称无管腺，其分泌物称激素（D对，故E为本题正确答案）。